患者，女，40岁，已婚。月经规律，平时带下量多，色黄，黏稠，无臭气，纳呆，大便黏腻不爽，苔黄腻，脉儒数。治疗应首选
A. 止带方
B. 内补丸
C. 易黄汤
D. 参苓白术散
E. 萆薢渗湿汤

正确答案：A。止带方

解析：湿热蕴结于下，损伤任带二脉，故带下量多，色黄，黏稠，湿邪阻碍脾气，运化无力，则纳呆，湿性重着黏腻。故大便黏腻不爽，苔黄腻，脉儒数均为湿热下注的表现，治当清利湿热，止帯方的功效为燥湿止带，为带下过多湿热下注的首选（A对）。内补丸的功效为温肾培元，固涩止带，治疗肾阳虚证（B错）。易黄汤的功效为健脾祛湿，清热止带，治疗脾虚湿蕴化热证（C错）。参苓白术散的功效为益气健脾，渗湿止泻，治疗脾虚湿盛证（D错）。萆薢胜湿汤的功效为健脾利湿，清热解毒，治疗湿毒瘀结证（E错）。